呋塞米利尿作用的机制是
A. 作用于髓袢升支粗段的髓质和皮质部，抑制Na⁺-K⁺-2cl共同转运系统
B. 作用于髓袢升支粗段的皮质部，抑制Na⁺-Cl⁻共同转运系统
C. 作用于远曲小管和集合管，竞争醛固酮受体，对抗醛固酮的作用
D. 作用于远曲小管和集合管，阻滞Na⁺通道，减少Na⁺的重吸收
E. 作用于近曲小管，抑制碳酸酐酶，减少H⁺-Na⁺交换

正确答案：A。作用于髓袢升支粗段的髓质和皮质部，抑制Na⁺-K⁺-2cl共同转运系统

解析：高效利尿药也称髓袢利尿药或Na⁺-K⁺-2Cl⁻一同向转运体抑制药。常用药物有呋塞米、依他尼酸、布美他尼、托拉塞米等。主要作用于髓袢升支粗段，抑制Na⁺-K⁺-2Cl⁻同向转运体，使Na⁺、Cl⁻重吸收减少，肾脏稀释功能降低，NaCl排出量增多（A对）。